连续用药4周才能出现疗效的药品是
A. 吸入型糖皮质激素
B. 非甾体抗炎药
C. β受体阻断剂
D. 短效β₂受体激动剂
E. 白三烯受体阻断剂

正确答案：E。白三烯受体阻断剂

解析：本题考查白三烯受体阻断剂。连续用药4周才能出现疗效的药品是白三烯受体阻断剂（E对）。白三烯受体拮抗剂具有如下特点：①不良反应少而轻。②起效慢，一般连续应用4周显效。③作用较弱，相当于色甘酸钠。仅适用于轻、中度哮喘和稳定期的控制，或合并应用以减少肾上腺皮质激素和β₂受体激动剂的剂量。吸入型糖皮质激素（A错）为控制呼吸道炎症的预防性用药，起效缓慢且需连续和规律地应用2日以上方能充分发挥作用。短效β₂受体激动剂（D错）通常在数分钟内起效，适用于迅速缓解轻、中度哮喘急性症状，也可用于运动性哮喘。